方颅可见于
A. 呆小症
B. 先天性梅毒
C. 脑膜炎
D. 脑积水
E. 小儿营养不良

正确答案：B。先天性梅毒

解析：头颅畸形可分为小颅、尖颅、方颅、巨颅、长颅及变形颅。方颅见于小儿佝偻病及先天性梅毒（B对）。呆小症（A错）表现为小颅，同时伴有智力障碍。脑膜炎（C错）、小儿营养不良（E错）头颅基本正常。脑积水（D错）表现为巨颅。